直接影响诊断试验阳性预测值的是
A. 发病率
B. 患病率
C. 死亡率
D. 生存率
E. 罹患率

正确答案：B。患病率

解析：本题考查直接影响诊断试验阳性预测值的指标。阳性预测值指筛检发现的阳性者中患目标疾病的人所占的比例。根据式7-15，阳性预测值和患病率（B对ACDE错）、灵敏度、特异度都有关系。